前间壁心肌梗死特征性心电图改变，见于
A. V₃、V₄、V₅
B. V₁、V₂、V₃、V₄、V₅
C. V₁、V₂、V₃
D. V₅、Ⅰ、aVL
E. Ⅱ、Ⅲ、aVF

正确答案：C。V₁、V₂、V₃

解析：前间壁心肌梗死特征性心电图改变常常表现在V₁、V₂、V₃导联（C对）。V₃、V₄、V₅（A错）与V₁、V₂、V₃、V₄、V₅（B错）见于广泛前壁梗死；V₅、Ⅰ、aVL（D错）见于侧壁梗死；Ⅱ、Ⅲ、aVF（E错）见于下壁梗死。